应用注射器采集空气样品时，采样体积一般不大于
A. 10ml
B. 50ml
C. 100ml
D. 150ml
E. 200ml

正确答案：C。100ml

解析：本题考查注射器采集样品的体积。采集空气样品时，注射器体积一般不能太大，否则会影响空气样品的质量和准确性。当注射器体积超过100ml时，它的体积将会过大，导致采集的空气样品经过注射器的预处理后，其中的微粒悬浮物会受到拖拽作用，使得采集到的空气样品中的微粒悬浮物含量增多，从而影响空气样品的质量和准确性。此外，当注射器体积超过100ml时，由于注射器体积过大，采集到的空气样品中的气体组成会受到影响，也会影响空气样品的质量和准确性。因此，在采集空气样品时，注射器的体积一般不能超过100ml（C对ABDE错）。